治疗初期颈痈，应首选
A. 五味消毒饮
B. 牛蒡解肌汤
C. 仙方活命
D. 黄连解毒汤
E. 普济消毒饮

正确答案：B。牛蒡解肌汤

解析：颈痈的发生多由外感风温、风热之邪，内伤情志，气郁化火，以致外邪内热夹痰蕴结于少阳、阳明经络，气血凝滞，热胜肉腐而成，或因患乳蛾、口疳、龋齿或头面疮疖毒邪流窜至颈部而成；治宜散风清热，化痰消肿，可用牛蒡解肌汤（B对）。五味消毒饮（A错）清热解毒，用于疔疮初起，壮热憎寒。仙方活命饮（C错）清热解毒，行瘀活血，用于一切痈疽肿疡、溃疡等。黄连解毒汤（D错）泻火解毒，用于一切疔疮及一切火毒热毒、发热、汗出、口渴等实证。普济消毒饮（E错）散风温，清三焦，解热毒，用于锁喉痈、发颐、抱头火丹等。